男性，36岁，咳痰一月余，痰中有血丝，偶尔咯血100ml，痰液分四层，x线无异常，考虑诊断为
A. 支气管扩张
B. 肺癌
C. 结核
D. 支气管肺炎
E. 肺水肿

正确答案：A。支气管扩张

解析：该患者男性，36岁，出现咳痰，痰中有血丝，偶尔咯血的表现，x线无异常，结合患者的表现，考虑诊断为支气管扩张（A对）。（P77）。痰血或咳血 咯血多见于中央型肺癌。肿瘤向管腔内生长者可有间歇或持续性痰中带血，如果表面糜烂严重侵蚀大血管，则可引起大咯血。（B错）。（P65）约1/3的人有咯血，多数病人为少咯血，少数为大咯血。结核病灶累及胸膜时可表现胸痛，为胸膜性胸痛。（C错）。支气管肺炎发病较急，感染症状比较明显。X线平片上表现为边界模糊的片状或斑点状阴影，密度不均匀，且不局限于一个肺段或肺叶。经抗菌药物治疗后，症状迅速消失，肺病变吸收也较快（D错）。（P166～167）急性左心衰发作时可出现粉红色泡沫样痰（E错）。